海绵状血管瘤是
A. 良性肿瘤
B. 恶性肿瘤
C. 交界性肿瘤
D. 癌前病变
E. 非肿瘤性良性病变

正确答案：A。良性肿瘤

解析：海绵状血管瘤属于间叶组织的良性肿瘤（A对B错）。交界性肿瘤（C错）为介于良性肿瘤和恶性肿瘤之间的肿瘤。癌前病变（D错）和非肿瘤性良性病变（E错）不属于肿瘤。